经肠内菌群代谢生成苷元，苷元再次解聚为大黄酸蒽酮发挥泻下作用的化合物是
A. 大黄酸
B. 番泻苷A
C. 大黄酚
D. 虎杖苷
E. 芦荟苷

正确答案：B。番泻苷A

解析：本题考查的是大黄中番泻苷的代谢转化途经。经肠内菌群代谢生成苷元，苷元再次解聚为大黄酸蒽酮发挥泻下作用的化合物是番泻苷A（B对）。在大黄含有的蒽酮类化合物中，番泻苷的泻下作用是最强的。番泻苷为大黄双蒽酮苷化合物，双蒽酮的二聚结构与其他大黄蒽醌类化合物不同，二聚结构在代谢过程中可以解聚形成单蒽酮结构，例如番泻苷A在肠内菌群的作用代谢成番泻苷元，番泻苷元进一步解聚后生成大黄酸蒽酮。大黄酸蒽酮与大黄中的大黄酸（A错）结构相比，少了一个氧代结构，这也是这两个化合物泻下活性不同的主要原因。